患者，女，28岁。月经提前1周，经量多，色鲜红，腰膝酸痛，五心烦热，舌质红，脉细数不宜选择的药组是
A. 生地牡丹皮
B. 丹皮地骨皮
C. 茜草蒲黄
D. 小蓟旱莲草
E. 艾叶炮姜

正确答案：E。艾叶炮姜

解析：此题为虚热的表现，故应清热、凉血。生地的功效为清热凉血，养阴生津；牡丹皮的功效为清热凉血，活血化瘀；均为清热凉血药（A对）。地骨皮功效凉血除蒸，清肺降火，为清虚热药（B对）。茜草的功效为凉血，祛瘀，止血，通经；蒲黄的功效为止血，化瘀，利尿通淋；均为化瘀止血药（C对）。小蓟的功效为凉血止血，散瘀解毒消痈；旱莲草的功效为滋补肝肾，凉血止血（D对）。而艾叶和炮姜均为温经止血药，常用于治疗虚寒证，故不宜选用（E错，为本题正确答案）。